属于物理配伍变化的是
A. 含酚羟基的药物遇铁盐颜色变深
B. 高锰酸钾与甘油混合研磨发生爆炸
C. 乌洛托品与酸类药物配伍产生甲醛
D. 氯霉素注射液与少量葡萄糖输液混合时产生沉淀
E. 生物碱盐溶液遇鞣酸产生沉淀

正确答案：D。氯霉素注射液与少量葡萄糖输液混合时产生沉淀

解析：本题考查药物的配伍变化。属于物理配伍变化的是氯霉素注射液与少量葡萄糖输液混合时产生沉淀（D对）。物理学的配伍变化是指药物配伍时发生了分散状态或其他物理性质的改变，属于外观变化，如果条件改变还可能恢复制剂的原来形式。含酚羟基的药物遇铁盐生成配合物颜色变深（A错）属于化学配伍变化。强氧化剂高锰酸钾与强还原性的甘油混合研磨发生爆炸（B错）属于化学配伍变化。乌洛托品与酸类药物配伍产生甲醛发生了氧化还原反应（C错）属于化学性配伍禁忌。生物碱盐溶液遇鞣酸产生沉淀（E错）属于化学配伍变化。